小儿遗尿的病因除肾气不足，脾肺气虚外，还可见于
A. 玩耍过度
B. 肝经湿热
C. 睡前多饮
D. 智力未全
E. 精神烦躁

正确答案：B。肝经湿热

解析：遗尿主要是膀胱不能约束所致，而造成膀胱失约的原因主要有：下元虚寒、肺脾气虚、心肾不交和肝经湿热（B对）。玩耍过度（A错）和睡前多饮（C错）引起的遗尿可以为生理现象，是由于婴幼儿对排尿控制能力差所致。智力未全（D错）和精神烦躁（E错）均不是小儿遗尿的病因。